在安静状态下，人体调节产热活动最重要的体液因素是
A. 甲状腺激素
B. 肾上腺素
C. 去甲肾上腺素
D. 乙酰胆碱
E. 孕激素

正确答案：A。甲状腺激素

解析：甲状腺激素（A对）是调节非战栗产热活动最重要的体液因素。1mgT4可使机体产热量增加约4200KJ，使基础代谢率（BMR）提高28%。甲状腺激素作用的特点是起效缓慢，但持续时间较长。肾上腺素（B错）、去甲肾上腺素（C错）和生长激素等也可刺激产热，它们的特点是起效较快，但维持时间较短，效果较弱。乙酰胆碱不能刺激产热（D错）。孕激素（P426）（E错）可使育龄妇女的基础体温呈双曲线，能在排卵后使基础体温升高0.5℃。